药物治疗龋齿不能达到的目的是
A. 维持牙列完整
B. 恢复外形
C. 抑制龋病进展
D. 避免并发症
E. 保护牙髓

正确答案：B。恢复外形

解析：本题考查龋病的药物治疗。药物治疗龋齿不能达到的目的是恢复外形（B错，为本题的正确答案）。釉质是不可再生的物质，药物治疗不能达到恢复牙齿外形的目的。药物治疗是使用化学药物治疗龋病，抑制龋病发展（C对），以达到维持牙列完整（A对）、避免并发症（D对）、保护牙髓的目的（E对）。龋病发展一旦造成了牙体组织的实质性缺损，是不能自行恢复其形态的，只能采用充填术进行治疗。